肝性脑病的诱因
A. 遗传性因索
B. 结核杆菌
C. 营养缺乏
D. 代谢因素
E. 食道静脉曲张破裂出血

正确答案：E。食道静脉曲张破裂出血

解析：肝硬化患者因食管静脉曲张破裂出血（E对）时，可致血氨水平急剧增高而诱发肝性脑病。